用某种方法进行女性乳腺癌筛检的研究，一般女性乳腺癌的患病率约为2/10万，患有乳腺增生症的女性患病率约为60/10万。在一般女性中进行筛检，筛检阳性者中仅0.1%患癌，如果在乳腺增生症患者中进行筛检，则20％筛检阳性者患癌，这说明在患病率高的人群中开展筛检
A. 特异度变化不大
B. 特异度降低
C. 敏感度降低
D. 阳性预测值升高
E. 敏感度变化不大

正确答案：D。阳性预测值升高